5～9岁的儿童蔗糖的合适摄入量为
A. 15～20g
B. 20～25g
C. 25～30g
D. 30～45g
E. 50～65g

正确答案：D。30～45g

解析：本题考查5～9岁的儿童蔗糖的摄入量。5～9岁的儿童蔗糖的合适摄入量为30～45g（D对）。致龋食物主要为蔗糖，其次为葡萄糖，因此在保证摄糖量满足生长发育的同时应减少摄入游离糖的量和频率，使用糖代替品。